不正确的是
A. 在桡骨颈高度由肱动脉分出
B. 尺动脉末端与桡动脉的掌浅支吻合成掌浅弓
C. 掌深弓上发出3条掌心动脉
D. 尺动脉发出拇主要动脉
E. 桡动脉末端与尺动脉的掌深支吻合成掌深弓

正确答案：D。尺动脉发出拇主要动脉

解析：桡动脉和尺动脉在桡骨颈高度由肱动脉分出（A对）。尺动脉末端与桡动脉的掌浅支吻合成掌浅弓（B对）。掌深弓上发出3条掌心动脉（C对）。尺动脉发出骨间总动脉和掌深支（D错，为本题正确答案）。桡动脉末端与尺动脉的掌深支吻合成掌深弓（E对）。